吗啡主要用于
A. 慢性钝痛
B. 急性锐痛
C. 分娩镇痛
D. 胃肠绞痛
E. 肾绞痛

正确答案：B。急性锐痛

解析：本题考查吗啡的镇痛作用。吗啡主要用于急性锐痛（B对）。吗啡类有强大镇痛作用，能在不影响意识和感觉的情况下明显消除痛觉反应，对各种原因引起的疼痛均有效。由于易成瘾，不用于慢性钝痛（A错），用于治疗其他镇痛药无效的急性锐痛。由于吗啡能通过胎盘抑制胎儿或新生儿呼吸，同时能对抗催产素对子宫的兴奋作用而延长产程，故不用于分娩镇痛（C错）。吗啡兴奋胃肠平滑肌和括约肌，提高其张力，甚至达到痉挛的程度，故不用于胃肠绞痛（D错）和肾绞痛（E错）。